属于Tl-Ag的物质有
A. 病原微生物
B. 肺炎链球菌莢膜多糖
C. 血细胞
D. 血清蛋白
E. 外毒素

正确答案：B。肺炎链球菌莢膜多糖